嗜酸性淋巴肉芽肿好发部位是
A. 下颌角
B. 颈部中线
C. 腭中缝
D. 上颌窦
E. 腮腺区

正确答案：E。腮腺区

解析：嗜酸性淋巴肉芽肿腮腺区、耳后等为多发部位病损。掌握“血管瘤及嗜酸性淋巴肉芽肿”知识点。